对于有睡眠障碍的抑郁症患者，适宜选用的抗抑郁药是
A. 地西泮
B. 雷美尔通
C. 米氮平
D. 佐匹克隆
E. 唑吡坦

正确答案：C。米氮平

解析：本题考查抗抑郁药。米氮平（C对）适用于各种抑郁症的急性期及维持期治疗，特别是治疗伴有睡眠障碍或焦虑障碍的抑郁症、伴有焦虑激越或焦虑躯体化的抑郁症患者。地西泮（A错）为抗焦虑药。雷美尔通（B错）、佐匹克隆（D错）及唑吡坦（E错）均用于治疗入睡困难或睡眠维持障碍。